止带方常用于治疗带下过多的何证型
A. 脾虚证
B. 湿毒证
C. 肾阳虚证
D. 肾阴虚证
E. 湿热下注证

正确答案：E。湿热下注证

解析：带下过多湿热下注证治法清利湿热，佐以解毒杀虫，用止带方，此方来源于《世补斋.不谢方》，方中猪苓、茯苓、车前子、泽泻利水渗湿止带；赤芍、丹皮清热，凉血活血；黄柏、栀子、茵陈泻热解毒，燥湿止带；牛膝利水通淋，引诸药下行，使热清湿除带自止。（E对）。带下过多脾虚证用完带汤（A错）。带下过多热毒蕴结证用五味消毒饮（B错）。带下过多肾阳虚证用内补丸（C错）。带下过多阴虚夹湿证用知柏地黄汤（C错）。